身热夜甚，心烦不寐，斑疹隐现，舌红绛，脉细数，其临床意义是.
A. 卫分证
B. 气分证
C. 营分证
D. 血分证
E. 热灼营阴证

正确答案：C。营分证

解析：卫气营血，代表着温热病浅深、轻重不同的四个病理阶段。邪热入营，灼伤营阴，夜与入阴之卫阳相搏，则身热夜甚；热深入营，侵扰心神，故心烦不寐；邪热入营，灼伤血络，则斑疹隐现；营分有热，劫伤营阴，故舌红绛，脉细数（C对）。卫分证表现为发热，微恶风寒，头痛，口干微渴，舌边尖红，苔薄黄，脉浮数（A错）。气分证表现为发热，不恶寒，反恶热，汗出，口渴，尿黄，舌红苔黄，脉数有力（B错）。血分证分为实热证和血分虚热证，血分实热证表现为身热夜甚，躁扰不宁，甚者神昏谵语，舌质深绛，脉弦数；血分虚热证表现为持续低热，暮热早凉，五心烦热，形体干瘦，神疲耳聋，舌干少苔，脉虚细（D错）。题干所描述属营分证，热灼营阴是导致身热夜甚、舌红绛脉细数的原因（E错）。